治疗敏感菌株所致伤寒、副伤寒的药物是
A. 氯霉素
B. 环丙沙星
C. 磺胺嘧啶
D. 红霉素
E. 呋喃妥因

正确答案：A。氯霉素

解析：本题考查氯霉素。氯霉素（A对）是伤寒、副伤寒的首选药物，可用于敏感菌引起的脑膜炎、眼部感染的治疗。环丙沙星（B错）用于敏感菌感染所致的泌尿生殖系统感染、呼吸道感染、胃肠道感染、伤寒、骨和关节感染、皮肤软组织感染、败血症等全身感染。磺胺嘧啶（C错）用于脑膜炎球菌所致的流行性脑脊髓膜炎的治疗和预防。红霉素（D错）是治疗百日咳、军团菌病、空肠弯曲菌肠炎和支原体肺炎的首选药。呋喃妥因（E错）用于治疗和预防敏感菌引起的急性单纯性泌尿道感染。